进入疟区时，作为病因性预防的常规用药是
A. 伯氨喹
B. 氯喹
C. 乙胺嘧啶
D. 增效磺胺
E. 奎宁

正确答案：C。乙胺嘧啶